患者，男，53岁，近日体检发现高血压，血压170/95mmHg，化验显示肝肾功能正常，血尿酸535umol/L。该患者不宣选用的降压药是
A. 氨氯地平
B. 依那普利
C. 特拉唑嗪
D. 氢氯噻嗪
E. 氯沙坦钾

正确答案：D。氢氯噻嗪

解析：本题考查引起血尿酸增高的药物。该患者不宣选用的降压药是氢氯噻嗪（D对）。氢氯噻嗪可引起血尿酸水平升高，本题中患者的血尿酸值为535㎛ol/L（正常值：男性208-428㎛ol/L），明显高于正常值。常使血尿酸增高的药物有：四氯化碳、铅中毒，或服用非甾体抗炎药（阿司匹林、贝诺酯）、利尿剂（氢氯噻嗪、托拉塞米、依他尼酸）、抗结核药（吡嗪酰胺、乙胺丁醇）等。氨氯地平（A错）、依那普利（B错）、特拉唑嗪（C错）、氯沙坦钾（E错）不会使血尿酸水平增高，该患者可以使用。